能作外展内收的关节是
A. 膝关节
B. 肘关节
C. 桡腕关节
D. 踝关节
E. 指间关节

正确答案：C。桡腕关节

解析：椭圆关节，关节头呈椭圆形凸面，关节窝呈相应椭圆形凹面，运动度较大。桡腕关节（C对）属于椭圆关节，关节囊松弛，关节灵活，可做内收、外展、屈、伸和环转运动。